慢性胃炎最可靠的临床诊断手段是
A. 胃镜检查和胃黏膜活检
B. X线钡餐检查
C. 胃液分析
D. 幽门螺杆菌检测
E. 抗壁细胞抗体测定

正确答案：A。胃镜检查和胃黏膜活检